《药物临床试验质量管理规范》规定，为确保临床试验中受试者的权益，须
A. 由国家卫生部成立伦理委员会
B. 由国家食品药品监督管理局成立伦理委员会
C. 成立独立的伦理委员会
D. 成立独立的伦理委员会，并向卫生部备案
E. 成立独立的伦理委员会，并向国家食品药品监督管理局备案

正确答案：E。成立独立的伦理委员会，并向国家食品药品监督管理局备案